下列属于拔牙的适应证的是
A. 一年前发生过心肌梗死
B. 急性肝炎
C. 月经期
D. 不稳定的心绞痛
E. 充血性心力衰竭

正确答案：A。一年前发生过心肌梗死

解析：6个月内发生过心肌梗死，应视为拔牙的禁忌证。掌握“牙拔除的适应证与禁忌证”知识点。